今天体育课要进行跨栏训练，课前，老师对跨栏和跑道进行了检查，这属于运动损伤预防措施中的
A. 安全防范法
B. 保护帮助法
C. 量力适应法
D. 准备活动法
E. 消除疲劳法

正确答案：A。安全防范法